心身疾病的治疗原则，不包括
A. 药物缓解症状
B. 自我心理调节
C. 矫正不良习惯
D. 不间断发泄
E. 心理护理

正确答案：D。不间断发泄